下列药品经营活动，符合国家相关规定的是
A. 甲药品经营企业销售的中药材标明了产地
B. 乙药品零售企业以“购二赠一”的方式促销甲类非处方药
C. 丙药品零售企业采购药品时索取销售凭证，销售凭证保存2年后销毁
D. 丁药品经营企业在产品订货会上，把展示的乙类非处方药以现货方式卖给参观者

正确答案：A。甲药品经营企业销售的中药材标明了产地

解析：本题考查药品经营管理甲药品经营企业销售的中药材标明了产地。下列药品经营活动，符合国家相关规定的是甲药品经营企业销售的中药材标明了产地（A对）。《中华人民共和国药品管理法》第五章药品经营第五十八条：药品经营企业零售药品应当准确无误，并正确说明用法、用量和注意事项；调配处方应当经过核对，对处方所列药品不得擅自更改或者代用。对有配伍禁忌或者超剂量的处方，应当拒绝调配；必要时，经处方医师更正或者重新签字，方可调配。药品经营企业销售中药材，应当标明产地。依法经过资格认定的药师或者其他药学技术人员负贵本企业的药品管理、处方审核和调配、合理用药指导等工作。药品零售企业不得采用开架自选的方式销售处方药，也不得采用“捆绑搭售”“买商品赠药品”“买N赠1”“满N减1”“满N元减×元”等方式直接或变相赠送销售处方药、甲类非处方药（B错）（包括通过网络销售的渠道）。药品批发企业药品经营活动：药品批发企业购进药品，应当建立并执行进货检查验收制度，索取、查验、留存《药品经营监督管理办法》规定的供货企业及其授权委托销售人员有关证件资料、销售凭证（保存至超过药品有效期1年，且不得少于5年）（C错），在验明药品合格证明和其他标识等证明药品合法性材料后方可购进、销售；不符合规定的，不得购进和销售。药品批发企业不得以展销会、博览会、交易会、订货会、产品宣传会等方式现货销售药品（D错）或赠送药品。